诊断职业性噪声聋分级最终的依据是
A. 诊断标准
B. 职业史
C. 噪声强度
D. 测听结果

正确答案：D。测听结果

解析：本题考查职业性噪声聋的分级依据。职业病致残程度鉴定：噪声聋是不可逆性疾病，确诊后需根据听力下降的程度（D对ABC错）进行职业病致残程度鉴定（GB/T16180-2014），共分七级，由重到轻依次为四级残至十级残。